《灵枢·顺气一日分为四时》“夫百病者…多以旦慧”，其原因是
A. 人气始生，病气衰
B. 人气长，长则胜邪
C. 人气始衰，邪气始生
D. 人气人脏，邪气独居于身
E. 人气抗邪，卫外为固

正确答案：A。人气始生，病气衰

解析：《灵枢·顺气一日分为四时》说：“夫百病者，多以旦慧、昼安、夕加、夜甚…朝则人气始生，病气衰，故旦慧（A对）；日中人气长，长则胜邪，故安；夕则人气始衰，邪气始生，故加；夜半人气入藏，邪气独居于身，故甚也。”